《温热论》中的“浊邪害清”之浊邪是指
A. 痰饮
B. 湿热
C. 湿浊
D. 瘀血
E. 肿瘤

正确答案：B。湿热

解析：叶天士说：“湿与温合，蒸郁而蒙蔽于上，清窍为之壅塞，浊邪害清也”。浊邪害清，浊邪，指湿热邪气（B对）；清，指轻清的阳气上通于头面的孔窍，如耳、目、口、鼻等。湿为重浊的邪气，与热邪相结合，湿热蕴积而上蒸，轻清的阳气被阻遏，以致孔窍壅塞，出现神识昏蒙、耳聋、鼻塞等症状。